银柴胡的性状鉴别特征是
A. 疙瘩丁
B. 星点
C. 起霜
D. 砂眼
E. 蚯蚓头

正确答案：D。砂眼

解析：本题考查的是银柴胡药材的性状鉴别。银柴胡的性状鉴别特征是砂眼（D对）。银柴胡：【性状鉴别】药材呈类圆柱形，偶有分枝。表面浅棕黄色至浅棕色，有扭曲的纵皱纹及支根痕，多具孔穴状或盘状凹陷，习称“砂眼”，从砂眼处折断可见棕色裂隙中有细砂散出。根头部略膨大，有密集的呈疣状突起的芽苞、茎或根茎的残基，习称“珍珠盘”。质硬而脆，易折断，断面不平坦，较疏松，有裂隙，皮部甚薄，木部有黄、白色相间的放射状纹理。气微，味甘。疙瘩丁（A错）为白芷药材的鉴别特征。白芷：【性状鉴别】药材呈长圆锥形。顶端有凹陷的茎痕，根头部钝四棱形或近圆形；表面灰黄色至黄棕色，具纵皱纹、支根痕及皮孔样横向突起，习称“疙瘩丁”，散生或排列成四纵行。质坚实，断面白色或灰白色，粉性，形成层环棕色，近方形或近圆形，皮部散有多数棕色油点，气芳香，味辛、微苦。星点（B错）为大黄药材的鉴别特征。大黄：【性状鉴别】药材呈类圆柱形、圆锥形、卵圆形或不规则块片状。除尽外皮者表面黄棕色至红棕色，有的可见类白色网状纹理及“星点”（异型维管束）散在，残留的外皮棕褐色，多具绳孔及粗皱纹。质坚实，有的中心稍松软，断面淡红棕色或黄棕色，显颗粒性；根茎髓部宽广，有“星点”环列或散在；根木部发达，具放射状纹理，形成层环明显，无“星点”。气清香，味苦而微涩，嚼之粘牙，有沙粒感。起霜（C错）为的附子药材盐附子鉴别特征。附子：【性状鉴别】药材盐附子呈圆锥形。表面灰黑色，被盐霜。顶端有凹陷的芽痕，周围有瘤状突起的支根或支根痕。体重，横切面灰褐色，可见充满盐霜的小空隙及多角形形成层环纹，环纹内侧导管束小点排列不整齐。气微，味咸而麻，刺舌。蚯蚓头（E错）为防风药材的鉴别特征。防风：【性状鉴别】药材呈长圆锥形或长圆柱形，下部渐细，有的略弯曲。根头部有明显密集的环纹，习称“蚯蚓头”，环纹上有的有棕褐色毛状残存叶基。表面灰棕色或棕褐色，粗糙，有纵皱纹、多数横长皮孔及点状突起的细根痕。体轻、质松，易折断，断面不平坦，皮部棕黄色至棕色，有裂隙，散生黄棕色油点，木质部浅黄色。气特异，味微甘。